氨基糖苷类药物引起的典型药源性疾病是
A. 胃肠类疾病
B. 肌病
C. 神经系统疾病
D. 血液系统疾病
E. 心血管系统疾病

正确答案：C。神经系统疾病

解析：本题考查药源性疾病。氨基糖苷类药物典型不良反应为耳毒性，包括前庭和耳蜗神经功能障碍（C对）。